人工喂养的婴儿最好选择
A. 鲜牛乳
B. 代乳品
C. 婴儿配方奶粉
D. 脱脂奶粉
E. 全脂奶粉

正确答案：C。婴儿配方奶粉

解析：本题考查人工喂养的婴儿最好选择的奶粉。完全人工喂养的婴儿最好选择婴儿配方奶粉（C对ABDE错）。